下列有关瘀血致病的特点，错误的是
A. 疼痛多为胀痛，有昼轻夜重的特点
B. 脉细涩沉弦或结代
C. 出血血色紫黯或夹有瘀血块
D. 肿块固定不移或拒按
E. 口唇、面部、爪甲青紫，舌质紫

正确答案：A。疼痛多为胀痛，有昼轻夜重的特点

解析：该题考查瘀血致病的特点。瘀血致病病症特点：①疼痛：一般表现为刺痛（A错，为本题正确答案）；②肿块：…肿块多固定不移（D对）；③出血：血色紫黯，或夹有瘀血块（C对）；④色紫黯：一是面色紫黯，口唇、爪甲青紫；二是舌质紫黯（E对）；⑤可表现出…如涩脉或结代脉等（B对）。